创立中医儿科五脏证治法则，并以之作为主要辨证依据的医家是
A. 钱乙
B. 刘昉
C. 曾世荣
D. 万全
E. 夏禹铸

正确答案：A。钱乙

解析：钱乙为儿科之圣，其代表作为《小儿药证直诀》，且首创儿科五脏辨证体系及从五脏论治（A对）。南宋刘昉的代表作为《幼幼新书》，是当时世界最完备的儿科学专著（B错）。元代曾世荣其代表作为《活幼心书》，是中医新生儿学较早的集中论述，以调元散、补肾地黄丸治疗胎怯（C错）。明代万全首先提出“三有余，四不足”的小儿生理病理学说，在治疗方面首重保护胃气，其著作颇丰（D错）。清代夏禹铸的代表作为《幼科铁镜》，认为“有诸内而形诸外”，运用“灯火十三燋”治疗脐风、惊风，重视推拿疗法的应用（E错）。